男，35岁。诊断为酒精所致精神障碍，入院后感到身体表面有许多虫子在皮肤上爬行，瘙痒难忍，焦躁不安。此症状最可能是
A. 幻触
B. 本体幻觉
C. 感觉过敏
D. 感觉到错
E. 错觉

正确答案：A。幻触

解析：患者中年男性，入院停止饮酒后感到有虫爬感等短暂性幻觉，考虑为幻触（A对）。本体幻觉（B错）是肌肉、肌腱、关节等本体感受器的幻觉。病人身体未动，却感到被人推动或自己在运动；未讲话，却感到口、舌在活动或在讲话。感觉过敏（C错）是对刺激的感受性增高，感觉阈值降低，表现对外界一般强度的刺激产生强烈的感觉体验，如感到阳光特别刺眼、柔和的音乐特别刺耳、轻微的触摸皮肤感到疼痛难忍等（P12）。感觉倒错（D错）对外界刺激可产生与正常人不同性质的或相反的异常感觉。例如对凉的刺激反而产生热点感觉。用棉球轻触皮肤时，病人产生麻木感或疼痛感。多见于癔症。错觉（E错）是对客观事物歪曲的知觉（P12）。